某女，35岁，久居湿热环境，患风湿热痹与脚气浮肿，宜选用的药是
A. 萆薢
B. 桑枝
C. 防己
D. 徐长卿
E. 海金沙

正确答案：C。防己

解析：本题考查的是防己的主治病证。久居湿热环境，患风湿热痹与脚气浮肿，宜选用的药是防己（C对）。防己：【主治病证】（1）风湿痹痛，尤以热痹为佳。（2）水肿，腹水，脚气浮肿，小便不利。萆薢（A错）：【主治病证】（1）膏淋，白浊。（2）湿盛带下。（3）风湿痹痛。桑枝（B错）：【主治病证】（1）风湿痹痛。（2）水肿，脚气浮肿。徐长卿（D错）：【主治病证】（1）风湿痹痛，脘腹痛，牙痛，术后痛，癌肿痛。（2）跌打肿痛。（3）风疹，湿疹，顽癣。（4）毒蛇咬伤。海金沙（E错）：【主治病证】（1）热淋，血淋，石淋，膏淋。（2）水肿。